以同一配液罐一次所配制的药液所生产的均质品为一批的属于
A. 大容量注射剂
B. 粉针剂
C. 固体制剂
D. 液体制剂
E. 冻干粉针剂

正确答案：A。大容量注射剂